患者突然跌倒，神志不清，口吐涎沫，两目上视，四肢抽搐，口中如作猪羊叫声，移时苏醒，舌苔白腻，脉弦滑。治疗应首选
A. 定痫丸
B. 导痰汤
C. 二阴煎
D. 涤痰汤
E. 控涎丹

正确答案：A。定痫丸

解析：题中患者突然跌倒，神志不清，口吐涎沫，两目上视，四肢抽搐，口中如作猪羊叫声，移时苏醒，为痫病的典型特征，故诊断为痫病。痫病以心脑神机失用为本，风火痰瘀为标，题中患者明显无火、瘀之象，为痰浊素盛，肝阳化风，痰随风动，风痰闭阻，上干清窍所致，舌苔白腻，脉弦滑为风痰之象，故辨为风痰闭阻证，治宜涤痰息风，开窍定痫。首选定痫丸（A对）。导痰汤功能燥湿祛痰，行气开郁，主治痰厥证（B错）。二阴煎功能功能滋阴降火，安神宁心，常合琥珀养心丹治疗狂证火盛伤阴证（C错）。涤痰汤功能涤痰开窍，主治中风痰迷心窍证，常合龙胆泻肝汤治疗痫病痰火扰神证（D错）。控涎丹功能祛痰逐饮，主治痰伏胸膈证，用于悬饮饮停胸胁证的治疗（E错）。